急性化脓性根尖周炎，以下哪一种排脓途径预后较差
A. 脓液穿通骨壁突破黏膜
B. 脓液穿通骨壁突破鼻腔
C. 脓液经根尖孔从冠部缺损处排出
D. 从龈沟或牙周袋排出
E. 以上都是

正确答案：D。从龈沟或牙周袋排出

解析：本题考查急性化脓性根尖周炎的排脓途径。急性化脓性根尖周炎有三种排脓途径：1.从龈沟或牙周袋排出（D对），通常预后较差，多发生于有深牙周袋的患牙，因根尖部脓灶与牙周袋底较近，脓液易从该薄弱的牙周结缔组织处突破而向牙周袋内排放，形成牙周窦道，经此途径排脓，牙周膜纤维遭到严重破坏，加重了牙周病病变，使患牙更为松动，甚至脱落；2.脓液经根尖孔从冠部缺损处排出（C错）对根尖周组织的破坏最小；3.通过骨髓腔突破骨膜、黏膜或皮肤向外排脓，这是最常见的典型自然发展过程，包括四种方式，即脓液穿通骨壁突破黏膜（A错）、脓液穿通骨壁突破鼻腔（B错）、突破皮肤、突破上颌窦壁，通常预后良好。